男性，50岁。近一月来常有刺激性咳嗽，无发热，应用止咳剂及抗生素治疗无效，X线摄片示：右肺下叶4cm×3.5cm块状影。应考虑的疾病是
A. 支气管肺炎
B. 肺结核
C. 肺癌
D. 肺脓肿
E. 支气管腺瘤

正确答案：C。肺癌

解析：50岁男性患者，有刺激性咳嗽、无发热，止咳剂及抗生素治疗无效（提示非肺部感染，考虑可能为肿瘤），X线片可见右肺下叶块状影（提示有肿块），结合患者病史、临床表现和影像学检查，该患者应考虑的疾病是右侧肺癌（C对）。支气管肺炎（A错）为感染性疾病，患者多有发热表现，抗生素治疗有效。肺结核（B错）多见于青年人，患者多有低热、盗汗等结核中毒症状。肺脓肿（D错）主要表现为高热、咳嗽，咳大量脓臭痰，Ｘ线可见空洞及气液平面，抗生素治疗有效。支气管腺瘤（E错）发病年龄较轻，常表现为呛咳、咯血及反复肺部感染，胸部X线呈圆形致密阴影。